维系蛋白质四级结构的主要化学键是
A. 氢键
B. 肽键
C. 二硫键
D. 疏水键
E. 范德华力

正确答案：D。疏水键